男性，55岁。患慢性支气管肺炎8年，近日来咳嗽加重，痰稀薄白色样，舌苔薄白，脉浮。治疗首选
A. 复方新诺明加二陈汤
B. 庆大霉素加清金化痰汤
C. 青霉素加麻杏石甘汤
D. 青霉素加参苏饮
E. 麦迪霉素加泻白散

正确答案：D。青霉素加参苏饮

解析：患者患慢性支气管肺炎8年，近日来咳嗽加重，应首先应用抗生素控制感染。常用抗生素可选用β-内酰胺类、大环内酯类、喹诺酮类等。青霉素属于β-内酰胺类抗生素。患者痰肺气亏虚，津液不布，聚为痰浊，故见痰稀薄白色样，舌苔薄白；脉浮，为肺气虚的表现。慢性支气管肺炎肺气虚证用参苏饮治疗，因为气虚外感风寒，内有痰湿，宜益气解表，理气化痰（D对）。二陈汤具有燥湿化痰，理气和中之功效，主治湿痰证（A错）。清金化痰汤可以清肺化痰，主治痰热壅肺证（B错）。麻杏石甘汤辛凉宣泄，清肺平喘之功效，主治外感风邪，邪热壅肺证（C错）。泻白散清脏腑热，清泻肺热，止咳平喘之功效，主治肺热喘咳（E错）。